手-足-口病管理应纳入
A. 甲类传染病管理
B. 乙类传染病管理
C. 丙类传染病管理
D. 丁类传染病管理
E. 戊类传染病管理

正确答案：C。丙类传染病管理

解析：本题考查手-足-口病。自2008年5月2日起，手-足-口病已纳入丙类传染病管理（C对）。